先天性Q-T间期延长综合征患者应避免使用的药物是
A. 氢氧化铝
B. 双歧杆菌三联活菌
C. 昂丹司琼
D. 利那洛肽
E. 奥美拉唑

正确答案：C。昂丹司琼

解析：本题考查昂丹司琼。先天性Q-T间期延长综合征患者应避免使用的药物是昂丹司琼（C对）。昂丹司琼可延长Q-T间期，并具有剂量依赖性，因此出现或可能出现Q-T间期延长的患者应慎用昂丹司琼；氢氧化铝（A错）是典型且常用的抗酸药，不应与熊去氧胆酸同服；双歧杆菌三联活菌（B错）主治肠道菌群失调，抗酸药、抗菌药与活菌制剂合用可减弱其疗效，避免同服；利那洛肽（D错）用于成人便秘型肠易激综合征（IBS-C）；奥美拉唑（E错）为质子泵抑制药，不与氯吡格雷联合使用。